治疗贫血
A. 抗CD3单克隆抗体
B. 抗肿瘤坏死因子抗体
C. β干扰素
D. α干扰素
E. EPO

正确答案：E。EPO

解析：贫血治疗分对症治疗和对因治疗。对症治疗如输血或红细胞及血浆等以减轻血细胞减少对患者造成的致命影响，为对因治疗发挥作用赢得时间；对因治疗是针对贫血的发病机制的治疗，如缺铁性贫血补铁及治疗缺铁的原发病，巨幼细胞性贫血补充叶酸或维生素B₁₂，ACD（慢性病性贫血）及肾性贫血采用EPO（E对）等。EPO为促红细胞生成素，是由肾皮质肾小管周围间质细胞和肝脏分泌的一种激素样物质，能够促进骨髓红细胞生成，用于治疗贫血，尤其是肾性贫血；抗CD3单克隆抗体（A错），为免疫抑制剂，产生免疫抑制作用和抗排斥作用；抗肿瘤坏死因子抗体（B错）主要用于治疗类风湿关节炎；β干扰素（C错）为治疗多发性硬化症的一线药物；α干扰素（D错）具有抗病毒、抗肿瘤和免疫调节作用，常用于急、慢性肝炎的治疗。